生物学宽度是指
A. 龈沟底与牙槽嵴顶之间的恒定距离
B. 龈沟底与牙槽嵴顶之间的距离约2mm，其改变可反映牙周状况
C. 牙周炎时生物学宽度增大
D. 牙周萎缩时生物学宽度变小
E. 随年龄增长上皮附着根向迁移，生物学宽度变小

正确答案：A。龈沟底与牙槽嵴顶之间的恒定距离

解析：通常将龈沟底与牙槽嵴顶之间的恒定距离称为生物学宽度，包括结合上皮和牙槽嵴顶上方的结缔组织，约2mm。随着年龄的增大或在病变情况下，上皮附着向根方迁移，牙槽嵴顶亦随之下降，沟（袋）底与牙槽嵴顶间的生物学宽度保持不变。掌握“牙周健康与修复”知识点。